某患者，男，55岁。舌根部肿瘤行放射治疗，放射治疗后，可能发生口腔改变的是
A. 口腔黏膜充血、水肿、溃疡
B. 皮肤变红、变黑、然后脱屑
C. 口腔黏膜炎症
D. 口干
E. 以上都是

正确答案：E。以上都是

解析：本题考查口腔颌面部肿瘤的治疗原则及预防。放射治疗中，可引起各种放射治疗反应，必须加以适当处理，以保证放射治疗计划顺利进行，常见的反应有以下几方面：皮肤反应可能出现皮肤变红、变黑、然后脱屑（B对），甚至发生脱毛、皮炎、溃疡等反应。口腔黏膜反应可出现炎症（C对）、充血、水肿、溃疡（A对）、白色假膜、出血等。如发生剧痛可加用表面麻醉剂含漱；如唾液腺被放射破坏，发生口干（D对）时，可对症选择针刺双侧颊车穴或口服养阴生津中药。全身反应可有食欲减退、恶心、呕吐、头昏、乏力，白细胞及血小板减少等。以上都是，因此选E。